下列不属于自杀死亡分类的是
A. 利己性自杀
B. 自我性自杀
C. 利他性自杀
D. 失范性自杀
E. 宿命性自杀

正确答案：A。利己性自杀

解析：本题考查自杀死亡的分类。自杀死亡可分为以下4大类：①自我性自杀（B对）；②利他性自杀（C对）；③失范性自杀（D对）；⑤宿命性自杀（E对）。利己性自杀（A错，为本题正确答案）不属于自杀死亡的分类。